某男，42岁。症见咽喉干痛、干咳少痰，医师处以养阴清肺膏。此因该中成药除能养阴、清肺、利咽外，又能
A. 润燥
B. 化痰
C. 宣肺
D. 解毒
E. 消肿

正确答案：A。润燥

解析：本题考查养阴清肺膏的功能。此因该中成药除能养阴、清肺、利咽外，又能润燥（A对）。养阴清肺膏【功能】养阴润燥，清肺利咽。二母宁嗽丸【功能】清肺润燥，化痰（B错）止咳。急支糖浆【功能】清热化痰，宜肺（C错）止咳。安宫牛黄丸（胶囊、散）【功能】清热解毒（D错），镇惊开窍。济生肾气丸（片）【功能】温肾化气，利水消肿（E错）。